Kennedy第一类缺失中混合支持式义齿的具体措施不正确的是
A. 用大连接体或基托连接
B. 取功能性印模或压力印模
C. 减小间接固位体和扩大鞍基
D. 减小人工牙颊、舌径、近远中径
E. 主要基牙上设计固位、支持、稳定作用良好的卡环

正确答案：C。减小间接固位体和扩大鞍基

解析：混合支持式义齿：此种设计适宜于双侧后牙部分或全部缺失、余留牙健康的情况下。具体措施a.在主要基牙上设计固位、支持、稳定作用良好的卡环；b.增加间接固位体和扩大鞍基，使（牙合）力分散到多个天然牙及更广泛的牙槽嵴上；c.取功能性印模或压力印模，以补偿鞍基下沉；d.减小人工牙颊、舌径、近远中径，或减少人工牙数目，以减小（牙合）力，相应减小基牙和牙槽嵴的负荷；e.采用应力中断式卡环或设计近中（牙合）支托，以缓冲主要基牙上的扭力；f.用大连接体或基托连接，以达到平衡和传递、分散（牙合）力的作用。掌握“局部义齿的设计”知识点。